肝硬化失代偿期最突出的表现
A. 腹水
B. 脾大及脾亢进
C. 低蛋白血症
D. 免疫因素
E. 门静脉高压

正确答案：A。腹水

解析：肝硬化失代偿期最突出的表现：腹水（A对）。